我国研制的没有“金鸡纳”反应的抗疟药
A. 奎宁
B. 青蒿素
C. 氯喹
D. 伯氨喹
E. 乙胺嘧啶

正确答案：B。青蒿素

解析：本题考查抗疟药的不良反应。我国研制的没有“金鸡纳”反应的抗疟药是青蒿素（B对）。青蒿素为菊科植物黄花蒿和大头黄花蒿中提取的一种倍半萜内酯过氧化物，是由我国科学家根据中医理论筛选发现的新型抗疟药。不良反应有胃肠道反应，偶见有四肢麻木感和心动过速。奎宁（A错）为奎尼丁的左旋体，用量过大或用药时间过久，常出现金鸡纳反应，表现为恶心、呕吐、头痛、头晕、耳鸣、视听力减退等。氯喹（C错）用于治疗疟疾时，产生轻度的头晕、头痛、胃肠不适、视觉障碍、荨麻疹等，停药后可很快消失。长期大剂量使用可引起不可逆视网膜病、耳毒性、心血管反应、白细胞减少以及肝脏和肾脏的损害。伯氨喹（D错）治疗量就可以引起疲倦、头晕、恶心、呕吐、腹痛、发绀等不良反应，少数人可出现药热、粒细胞缺乏症等，停药后可恢复。少数特异质的患者可发生急性溶血性贫血和高铁血红蛋白血症。乙胺嘧啶（E错）不良反应较少，长期服用可引起巨幼红细胞性贫血或白细胞减少症，可用亚叶酸钙（甲酰四氢叶酸钙）治疗。